社区口腔卫生服务的任务包括
A. 坚持政府领导部门协同
B. 坚持低成本广覆盖
C. 提高专业人员的素质
D. 提供基本口腔卫生服务
E. 营造团结和谐社区

正确答案：D。提供基本口腔卫生服务

解析：本题考查社区口腔卫生服务的任务。社区口腔卫生服务的任务包括提供基本口腔卫生服务（D对）。社区口腔卫生服务的任务包括：1.提高人群口腔健康水平；2.提供基本口腔卫生服务；3.营造口腔健康社区；4.保证区域卫生（包括口腔卫生）规划的实施；5.完善社区口腔卫生服务机构的功能。坚持政府领导部门协同（A错）、坚持低成本广覆盖（B错）、提高专业人员的素质（C错）、营造团结和谐社区（E错）均不属于社区口腔卫生服务的任务。